药品不良反应监测专业机构的人员应由
A. 医学技术人员担任
B. 药学技术人员担任
C. 有关专业技术人员担任
D. 护理技术人员担任
E. 医学、药学及有关专业的技术人员组成

正确答案：E。医学、药学及有关专业的技术人员组成

解析：药品不良反应监测的人员，由医学、药学及有关专业的技术人员组成。掌握“药品不良反应概念、报告、处置与法律责任”知识点。